可有痉挛性斜颈表现的病是
A. 帕金森病
B. 锥体系损害
C. 舞蹈病
D. 脑干疾病
E. 肌张力障碍

正确答案：E。肌张力障碍

解析：痉挛性斜颈是由于局限性肌张力障碍（E对），以胸锁乳突肌、斜方肌为主的颈部肌群阵发性不自主收缩，引起头向一侧扭转或阵挛性倾斜。帕金森病（A错）临床主要特征为静止性震颤、运动迟缓、肌强直和姿势平衡障碍（P279）。锥体系损害（B错）损害表现为中枢性瘫痪，颈部肌肉随意运动消失，还有四肢随意运动消失，肌张力增高，腱反射亢进，病理征阳性。舞蹈病（C错）表现为肌张力降低，不自主增多，主要累及面部及肢体远端（P289）。脑干疾病（D错）主要表现为交叉性瘫痪及脑神经核受损征象。